高危人群即
A. 出现某一效应的风险较大的人群
B. 易感人群
C. 抵抗力低的人群
D. 多病的人群
E. 年龄幼小的人群

正确答案：A。出现某一效应的风险较大的人群

解析：本题考查高危人群。高危人群即出现某一效应风险较大的人群（A对BCDE错），多为高暴露人群和(或)易感人群。